男性患儿，7岁，右下第一恒磨牙检查根尖周炎。医生采用根尖诱导成形术来进行治疗，医生这样进行治疗的生理基础是
A. 牙髓的未分化间充质细胞
B. 发育期根端复合体
C. 上皮根鞘
D. 缩余釉上皮
E. 釉小皮

正确答案：B。发育期根端复合体

解析：本题考查牙体、牙周组织的形成。牙发育过程中，发育期根端复合体（B对）细胞较之于其他牙源性间充质干细胞具有更强的增殖能力和矿化能力，被分离的发育期根端复合体在体外、体内仍具有形成牙根-牙周组织复合体的能力。这就是年轻恒牙进行根尖诱导成形术的生理基础。